以下属于药剂学配伍变化的有
A. 活性炭吸附生物碱
B. 高分子溶液的盐析
C. 乳剂的分层
D. 人参与莱菔子同用
E. 氨基糖苷不能和利尿药合用

正确答案：A、B、C。活性炭吸附生物碱；高分子溶液的盐析；乳剂的分层

解析：本题考查药剂学的配伍变化。以下属于药剂学配伍变化的有活性炭吸附生物碱（A对）、高分子溶液的盐析（B对）、乳剂的分层（C对）。药剂学物理配伍变化：物理配伍变化，是指制剂在配伍制备、贮存过程中，发生了物理性质的改变，从而影响制剂的外观或内在质量的变化。例如醇性制剂中的树脂在水性制剂中由于溶解度降低而析出；含低共熔成分的制剂久贮结聚而丧失干燥均匀的状态；剂量较小的生物碱盐与吸附性较强的固体粉末（如活性炭、白陶土等）配伍时，前者被后者吸附而减少在机体中的释放等。物理配伍变化：（1）溶解度的改变：1.温度改变。2.药渣吸附。3.盐析作用，在溶液中加入无机盐类可使某些成分溶解度降低面析出。。4.增溶作用。5.改变溶剂。6.贮藏过程。（2）吸湿，潮解、液化与结块：1.吸湿与潮解2.液化3.结块。（3）粒径或分散状态的改变：中药制剂组分或制剂本身的粒径或分散状态改变可直接影响制剂的质量。例如乳剂、混悬剂中分散相的粒径可因与其他药物配伍而变大，分散相聚结、凝聚或分层，导致使用不便或分剂量不准，甚至影响药物在体内的吸收。中药配伍禁忌相恶：即两药合用，一种药物能使另一种药物原有功效降低，甚至丧失。如人参恶莱菔子（D错），因莱菔子能削弱人参的补气作用。药理学的配伍变化是指药物配伍使用后，使药理作用的性质和强度发生变化，产生协同作用、拮抗作用、不良反应。不良反应：某些药物配伍后，能产生毒性或副作用等不良反应。这种情况不宜配伍使用或应慎用。例如：中药川乌、草乌、附子及含有生物碱的中成药与链霉素、庆大霉素及卡那霉素等氨基糖苷类（E错）药物合用时，可能会增加对听神经的毒性，引起耳鸣、耳聋等副作用。